关于端脑，何者错误
A. 主要指大脑两半球
B. 端脑就是大脑半球加间脑
C. 大脑表面的灰质层称大脑皮质
D. 大脑髓质内包埋着基底核
E. 大脑半球内的腔隙为侧脑室

正确答案：B。端脑就是大脑半球加间脑

解析：端脑是脑的最高级部位，主要指大脑两半球（A对B错，为本题正确答案）。大脑表面的灰质层称大脑皮质（C对），深部的白质称髓质，大脑髓质内包埋着基底核（D对），大脑半球内的腔隙为侧脑室（E对）。